男，60岁，突发喘憋1小时。查体：BP160/70mmHg，双肺满布湿性啰音，心率105次/分，该患者最适宜的治疗措施是
A. 口服氨苯蝶啶
B. 静脉滴注小剂量多巴胺
C. 静脉推注呋塞米
D. 口服螺内酯
E. 口服氢氯噻嗪

正确答案：C。静脉推注呋塞米

解析：患者老年男性，有高血压（收缩压≥140mmHg），突发喘憋，双肺满布湿性啰音，心率105次／分（正常值60～100次/分，稍偏高），此为急性左心衰竭引起急性肺水肿的典型表现。急性左心衰竭时基本处理包括体位处理（半卧位或端坐位以减少静脉回流）、吸氧、准备静脉通道、静脉注射吗啡、快速利尿等。呋塞米能迅速降低全身静脉血容量，降低左室充盈压，减轻肺淤血，急性左心衰竭伴发急性肺水肿时首选呋塞米静脉推注（C对）。口服氨苯蝶啶（A错）、螺内酯（D错）和口服氢氯噻嗪（E错）均可有利尿作用，但发挥效果缓慢，不适合急性心衰的治疗。多巴胺为β受体兴奋剂，静脉滴注小剂量多巴胺（P176）（B错）可通过降低外周阻力，增加肾血流量，增加心肌收缩力和心输出量而有利于改善急性左心衰的病情，但并非最适宜的治疗措施。